表观分布容积V反映了药物在体内的分布情况。地高辛的表观分布容积V通常高达500L左右，远大于人的体液的总体积，可能的原因有
A. 药物与组织大量结合，而与血浆蛋白结合较少
B. 药物全部分布在血液中
C. 药物与组织的亲和性强，组织对药物的摄取多
D. 药物与组织几乎不发生任何结合
E. 药物与血浆蛋白大量结合，而与组织结合较少

正确答案：A、C。药物与组织大量结合，而与血浆蛋白结合较少；药物与组织的亲和性强，组织对药物的摄取多

解析：本题考查表观分布容积。地高辛的表观分布容积V通常高达500L左右，远大于人的体液的总体积，可能的原因有药物与组织大量结合，而与血浆蛋白结合较少（A对）；药物与组织的亲和性强，组织对药物的摄取多（C对）；一般水溶性或极性大的药物，不易进入细胞内或脂肪组织中，血药浓度高，表观分布容积较小；亲脂性药物在血液中浓度较低，表观分布容积通常较大，往往超过体液（E错）；药物全部分布在血液中，血药浓度较高，表观分布容积较小（B错）；药物与组织的亲和性强，组织对药物的摄取多，药物在血浆中的浓度较低，表观容积较大（D错）。